影响致畸物经胎盘转运作用的因素是
A. 化学物的分子大小
B. 化学物的脂溶性和与蛋白质结合能力
C. 胎盘的结构
D. 胎盘中生物转化酶
E. 以上都是

正确答案：E。以上都是

解析：本题考查影响致畸物经胎盘转运作用的因素。致畸作用是指能作用于妊娠母体，干扰胚胎的正常发育，导致先天性畸形的毒作用。影响致畸物经胎盘转运作用的因素包括化学物的分子大小、化学物的脂溶性和与蛋白质结合能力、胎盘的结构以及胎盘中生物转化酶（E对ABCD错）。